易并发硬膜下积液的化脓性脑膜炎的病原菌是
A. 脑膜炎双球菌、肺炎链球菌
B. 溶血性链球菌、脑膜炎双球菌
C. 金黄色葡萄球菌、大肠杆菌
D. 肺炎链球菌、流感嗜血杆菌
E. 流感嗜血杆菌、金黄色葡萄球菌

正确答案：D。肺炎链球菌、流感嗜血杆菌

解析：化脓性脑膜炎（P402）是各种化脓性细菌引起的脑膜炎症，部分患者病变累及脑实质。约30%～60%的化脓性脑膜炎患儿出现硬膜下积液（图16-2），1岁以内的流感嗜血杆菌或肺炎链球菌脑膜炎患儿较多见。其发生机制尚未完全明确，可能与以下2个因素有关：①化脑时，血管通透性增加，血浆成分易进硬膜下腔而形成积液；②在化脑的发病过程中，硬脑膜及脑组织表浅静脉发生炎性栓塞，尤其是以穿过硬膜下腔的桥静脉炎性栓塞的影响更大，可引起渗出或出血，局部渗透压增高，因此水分进入硬膜下腔形成积液（八年制儿科学第二版P413）（D对）。